根据G.V.Black分类法，临床上Ⅲ类洞指的是
A. 所有牙面发育点裂隙沟的龋损所备成的窝洞
B. 发生于后牙邻面的龋损所备成的窝洞
C. 前牙邻面未累及切角的龋损所备成的窝洞
D. 为发生于所有牙齿近龈1/3牙面的龋损所制备的窝洞
E. 前牙邻面累及切角的龋损所备成的窝洞

正确答案：C。前牙邻面未累及切角的龋损所备成的窝洞

解析：本题考查Black分类。根据G.V.Black分类法，临床上Ⅲ类洞指的是前牙邻面未累及切角的龋损所备成的窝洞（C对）。Ⅲ类洞包括切牙和尖牙的邻面洞、邻舌面和邻唇面洞。G.V.Black以龋损发生的部位为基础，将窝洞分为5类，该分类法是且前国际上普遍采用的窝洞分类法。I类洞：所有牙面发育点隙裂沟的龋损所备成的窝洞（A错）；II类洞：后牙邻面的龋损所备成的窝洞（B错）；Ⅲ类洞：前牙邻面未累及切角的龋损所备成的窝洞；IV类洞：前牙邻面累及切角的龋损所备成的窝洞（E错）；V类洞：所有牙齿颊（唇）舌面颈1/3处的龋损所备成的窝洞（D错）。